影响龋病流行的有关因素不包括
A. 糖的摄入量
B. 糖的摄入频率
C. 钙的摄入量
D. 氟的摄入量
E. 饮食习惯

正确答案：C。钙的摄入量

解析：本题考查影响龋病流行的因素。钙的摄入量（C错，为本题的正确答案）和牙齿发育期间的钙化程度有关，适量的钙摄入量有利于牙齿的钙化，增强牙齿抗龋能力，与龋病的流行无直接关系。与龋病流行的因素包括糖的摄入量（A对）：糖的摄入量越多越易引起龋齿流行；糖的摄入频率（B对）：糖的摄入频率越频繁越易引起龋病的流行；氟的摄入量（D对）：在一定量下氟的摄入量越多龋病的发病率越少，但不可摄入过多的氟，否则会导致氟斑牙；饮食习惯（E对），喜食甜食的人更易患龋。